分子中含有巯基，对血管紧张素转换酶（ACE）产生较强抑制作用的抗高血压药物是
A. 卡托普利
B. 马来酸依那普利
C. 福辛普利
D. 赖诺普利
E. 雷米普利

正确答案：A。卡托普利

解析：本题考查卡托普利。卡托普利（A对）是ACE抑制剂中唯一含有巯基的，依那普利（B错）、福辛普利（C错）、赖诺普利（D错）、雷米普利（E错）均不含巯基。